不符合炭疽病现场处理原则的是
A. 工具煮沸消毒
B. 立即宰杀同群牲畜
C. 漂白粉或5%NaOH溶液消毒现场
D. 屠宰人员用青霉素进行预防注射
E. 屠宰人员手和衣物用2%来苏消毒

正确答案：B。立即宰杀同群牲畜